呕吐的发病机理是
A. 肝气不舒，横逆反胃
B. 中焦气滞，浊气上逆
C. 胃失和降，胃气上逆
D. 中阳不振，胃失和降
E. 胃失濡润，和降失司

正确答案：C。胃失和降，胃气上逆

解析：呕吐是指胃失和降，气逆于上，迫使胃内容物从口而出的病证。胃居中焦，主受纳和腐熟水谷， 其气下行，以和降为顺。邪气犯胃或胃虚失和，气逆于上则出现呕吐。故其基本病机为胃失和降，胃气上逆（C对），治以和胃降逆止呕。